肝的主要功能是分泌胆汁、参与代谢、贮存糖原、解毒及吞噬防御等，胚胎时期还有造血功能。肝呈楔形，分为上、下2面和前、后、左、右4缘。肝的上面隆凸，与膈相接，称膈面。膈面被镰状韧带分为大而厚的右叶和小而薄的左叶。肝下面凹凸不平，与腹腔脏器相邻，称脏面。脏面有一近似“H”形的沟，即２条矢状位的左、右纵沟和１条冠状位的横沟。关于肝的形态，正确的是
A. 膈面被镰状韧带分为大而厚的左叶和小而薄的右叶
B. 脏面朝向下前方，有“H＂形沟
C. 肝脏面右纵沟前部为胆囊窝
D. 肝上缘为肝脏面与膈面分界处
E. 第二肝门位于下腔静脉沟底，为肝门静脉开口于下腔静脉处

正确答案：C。肝脏面右纵沟前部为胆囊窝

解析：肝膈面被镰状韧带分为小而薄的左叶和大而厚的右叶(A错)，脏面朝向下方(B错)，脏面的右纵沟前部为胆囊窝(C对)，肝前缘为肝脏面与膈面分界处(D错)，第二肝门位于腔静脉沟上端(E错)。